男，72岁。近半月出现尿频、尿急、尿流缓慢，自觉骨痛，下肢出现水肿，血清前列腺特异抗原升高，考虑诊断为
A. 肾癌
B. 肾母细胞瘤
C. 膀胱癌
D. 前列腺癌
E. 睾丸癌

正确答案：D。前列腺癌